木香顺气丸除健脾和胃外，又能
A. 降逆止呕
B. 行气活血
C. 温中理气
D. 行气化湿
E. 疏肝理气

正确答案：D。行气化湿

解析：本题考查的是木香顺气丸的功能。木香顺气丸除健脾和胃外，又能行气化湿（D对）。木香顺气丸：【功能】行气化湿，健脾和胃。半夏：【功效】燥湿化痰，降逆止呕（A错），消痞散结。血府逐瘀口服液：【功能】活血祛瘀，行气（B错）止痛。小茴香：【功效】散寒止痛，理气和胃。小茴香长于温中理气（C错），又能暖肝温肾，善治寒疝腹痛、睾丸偏坠胀痛及经寒痛经。柴胡舒肝丸：【功能】疏肝理气（E错），消胀止痛。